控制疟疾复发和传播宜选用的抗疟药是
A. 乙胺嘧啶
B. 伯氨喹
C. 青蒿素
D. 氯喹
E. 奎宁

正确答案：B。伯氨喹

解析：本题考查伯氨喹。伯氨喹（B对）临床上作为控制复发和阻止疟疾传播的首选药，对红细胞外期及各型疟原虫的配子体均有较强的杀灭作用。乙胺嘧啶（A错）可抑制疟原虫的二氢叶酸还原酶而干扰疟原虫叶酸的正常代谢，对恶性疟及间日疟原虫红细胞前期有效，常用作病因性预防药。此外，也能抑制疟原虫在蚊体内的发育，故可阻断传播。临床上用于预防疟疾和休止期抗复发治疗。青蒿素（C错）对细胞内期疟原虫有杀灭作用，对外期疟原虫无效。氯喹（D错）作用机制是抑制DNA的复制和转录，抑制疟原虫的增殖。奎宁（E错）和氯喹作用类似。